无论发生次数还是中毒人数，在我国占食物中毒总数第一位的是
A. 细菌性食物中毒
B. 有毒动植物食物中毒
C. 化学性食物中毒
D. 霉变食物引起的食物中毒
E. 真菌毒素

正确答案：A。细菌性食物中毒